关于毒性，下列说法错误的是
A. 毒性的大小是相对的，取决于此种物质与机体接触的量
B. 毒性较高的物质，只要相对较小的剂量，即可对机体造成一定的损害
C. 毒性是物质一种内在的、不变的性质，取决于物质的物理性质
D. 我们不能改变毒性，但能改变物质的毒效应

正确答案：C。毒性是物质一种内在的、不变的性质，取决于物质的物理性质

解析：本题考查毒性的相关内容。毒性是指在特定条件下，化学物导致机体有害作用的一种内在的、固有的能力。毒性是物质一种内在的、不变的性质，取决于该物质的化学性质（C错，为本题正确答案）。毒性的大小是相对的，关键是此种物质与机体接触的量（A对）。毒性较高的物质，只要相对较小的剂量，即可对机体造成一定的损害（B对）。毒性是化学物固有的生物学内在属性，我们不能改变化学物的毒性。而毒效应是化学物毒性在某些条件下引起机体出现的有害的生物学效应，是化学物内在毒性在一定条件下（如一定的剂量等）的外在表现，改变条件就可能影响毒效应（D对）。